男，62岁。左胸痛5天，胸闷、气促2天。査体：双下肺呼吸音粗，心率108次/分，P₂﹥A₂。胸部X线片示左下肺透亮度增加。对明确诊断最有价值的价值是
A. CT肺动脉造影（CTPA）
B. 胸部高分辨CT
C. 心电图
D. 血D-二聚体
E. 超声心动图

正确答案：A。CT肺动脉造影（CTPA）

解析：患者老年男性，左胸痛5天，胸闷、气促2天（肺血栓栓塞常见症状）。査体：双下肺呼吸音粗，心率108次/分，P₂﹥A₂（肺血栓栓塞常见体征）。胸部X线片示左下肺透亮度增加（肺血栓栓塞常见影像学表现）。结合患者临床表现及相关辅助检查，该患者疑诊为肺栓塞。肺栓塞的确诊检查包括：①螺旋CT②放射性核素肺通气/血流灌注（V/Q）显像③磁共振成像和磁共振肺动脉造影④CT肺动脉造影（A对）；高分辨CT（B错）是支气管扩张的确诊检查；心电图（C错）为心脏循环系统方面疾患的首选检查；血D-二聚体（D错）可作为肺栓塞的筛查，但不具有特异性，因而不能作为确诊检查；超声心动图（E错）为器质性心脏病的确诊检查。